下列哪种职业中毒会引起肢端溶骨症
A. 二异氰酸甲苯酯
B. 氯乙烯
C. 聚乙烯
D. 含氟塑料

正确答案：B。氯乙烯

解析：本题考查引起肢端溶骨症的职业中毒。肢端溶骨症的早期表现为雷诺综合征：手指麻木、疼痛、肿胀、变白或发绀等。随后逐渐出现末节指骨骨质溶解性损害。目前认为，肢端溶骨征是氯乙烯（B对ACD错）所致全身性改变在指端局部的一种表现。肢端溶骨症的发生常伴有肝、脾大，对诊断有辅助意义。